女，30岁，不婚主义者，想去医院接受人工授精，但是被拒绝了，涉及的医院伦理学问题是
A. 保护后代原则
B. 患者有利原则
C. 保密原则
D. 社会公益原则
E. 知情同意原则

正确答案：D。社会公益原则

解析：患者为单身妇女，不符合辅助生殖技术应用伦理准则，其涉及的医院伦理学问题是社会公益原则（D对）。保护后代原则（A错）一般指的是对辅助生殖技术产生的后代有享受同等权利等。患者有利原则（B错）一般指的是在整个辅助生殖技术应用过程中应该倾向于利于患者等。保密原则（C错）一般指的是互盲原则、对使用人类辅助生殖技术的所有参与者（例如卵子捐赠者和接受者）有实行匿名和保密的义务等。知情同意原则（E错）一般指的是术前应该签署书面知情同意书等。